下列哪项不属于痛经的表现
A. 经前小腹及腰部疼痛
B. 月经周期正常，两次行经之间突然腹痛
C. 月经净后腰腹疼痛
D. 经期小腹刺痛
E. 行经期间，小腹剧痛难忍，伴面白，汗出，手冷，每次行经均有同样症状解

正确答案：B。月经周期正常，两次行经之间突然腹痛

解析：痛经的临床表现为腹痛多发生在经行前1-2天，行经第1天达高峰，疼痛多呈阵发性、痉挛性，或呈胀痛或伴下坠感（D对）。疼痛常可放射至腰骶部（A对）、肛门、阴道及大腿内侧。痛甚者可伴面色苍白，出冷汗，手足发凉，恶心呕吐，甚至昏厥等（E对）。也有少数于经血将净或经净后1-2天始觉腹痛或腰腹痛者（C对）（B错，为本题正确答案）。